地西泮的药理作用有
A. 抗焦虑
B. 镇静
C. 催眠
D. 抗抑郁
E. 抗癫痫

正确答案：A、B、C、E。抗焦虑；镇静；催眠；抗癫痫

解析：本题考查镇静催眠药地西泮。地西泮为苯二氮䓬类药物，能够抗焦虑（A对）、镇静（B对）、催眠（C对）、抗癫痫（E对），不用作抗抑郁（D错）药。